慢性支气管炎与支气管扩张的主要鉴别点
A. 咯血
B. 杵状指
C. 脓性痰
D. 支气管造影术
E. 胸部X线片

正确答案：D。支气管造影术

解析：慢支和支扩早期的胸部X线片均可表现为肺纹理的增粗、紊乱（E错），晚期支扩患者胸部X线片可出现典型的卷发状阴影。慢性支气管炎和支扩均为慢性疾病，长期缺氧均可导致杵状指（B错）。同样，咳血、脓性痰不具特异性，均可见于二者。支气管造影（D对）可明确支气管扩张的出血、扩张、阻塞的部位，是过去诊断支气管扩张的金标准，可用来与慢性支气管炎鉴别。